女，23岁，近1周以来牙龈疼痛极易出血，有异常口气，并见下颌前牙唇侧龈乳头坏死，其最可能的诊断和致病菌是
A. 妊娠期龈炎，中间普氏菌
B. 急性坏死性溃疡性龈炎，螺旋体和梭形杆菌
C. 慢性龈缘炎，粘性放线菌
D. 青春期龈炎，牙龈卟啉单孢菌
E. 增生性龈炎，内氏放线菌

正确答案：B。急性坏死性溃疡性龈炎，螺旋体和梭形杆菌

解析：本题考查急性坏死性溃疡性龈炎的临床表现及其致病菌。女，23岁，近1周以来牙龈疼痛极易出血，有异常口气，并见下颌前牙唇侧龈乳头坏死，其最可能的诊断是急性坏死性溃疡性龈炎，致病菌是螺旋体和梭形杆菌（B对）。根据题目中的信息牙龈疼痛极易出血，有异常口气，下颌前牙唇侧龈乳头坏死，可诊断为急性坏死性溃疡性龈炎，其致病菌为螺旋体和梭形杆菌。妊娠期龈炎表现为一个或多个牙龈乳头呈瘤样肥大，易出血，一般无疼痛，龈缘有溃疡和假膜形成，可有疼痛（A错）。慢性龈缘炎，牙龈的炎症一般局限于龈乳头和龈缘，患者可在刷牙或咬硬物时出血，龈乳头圆钝变大，牙龈质地松软变脆，龈沟深度探诊超过3mm，探诊出血，龈沟液量增多，无疼痛和典型的口臭（C错）。青春期龈炎，唇侧牙龈肿胀，龈乳头呈球状突起，颜色暗红或鲜红，光亮，质地软，探诊易出血，附着无变化（D错）。